普查筛检结肠癌的方法是
A. 粪隐血
B. 结肠镜
C. CT
D. 超声
E. MRI

正确答案：A。粪隐血